患者，男，20岁。突发胸闷，气急，咳嗽。听诊：两肺满布哮鸣音。应首先考虑的是
A. 急性支气管炎
B. 慢性支气管炎喘息型
C. 心源性哮喘
D. 支气管哮喘
E. 支气管肺癌

正确答案：D。支气管哮喘

解析：患者青少年男性（支气管哮喘常见人群），突发胸闷，气急，咳嗽（支气管哮喘常见症状），听诊：两肺满布哮鸣音（支气管哮喘的特征性体征）。该患者应首先考虑的是支气管哮喘（D对）。急性支气管炎（P17）（A错）起病较急，可有发热，常出现咳嗽和咳痰症状。慢性支气管炎喘息型（P20）（B错）多缓慢起病，病程长，主要症状为咳嗽、咳痰并伴有喘息。心源性哮喘（P166）（C错）常见于左心衰竭。支气管肺癌（P78）（E错）常发生于有长期大量吸烟史的老年人，多伴有咳嗽、咯血、气短、发热和体重下降等症状。